6α、9α双氟取代的药物是
A. 醋酸氢化可的松
B. 醋酸地塞米松
C. 醋酸泼尼松龙
D. 醋酸氟氢松
E. 醋酸曲安奈德

正确答案：D。醋酸氟氢松